下列不属于产前诊断方法的是
A. 绒毛穿刺取样
B. 血清学测甲胎蛋白
C. 羊水穿刺
D. 经皮脐血穿刺
E. 胚胎植入前诊断

正确答案：B。血清学测甲胎蛋白

解析：血清甲胎蛋白（B错，为本题正确答案）、hCG和游离E₃为妊娠中期筛查指标（P161）。胎儿染色体病的产前诊断过程中，获取胎儿细胞和染色体的方法有：胚胎植入前遗传诊断（E对）、绒毛穿刺取样（CVS）（A对）、羊膜腔穿刺术（C对）、经皮脐血穿刺技术（PUBS）（D对）、胎儿组织活检。